有关锁骨下动脉的下列叙述，不正确的是
A. 是指从发出至第一肋外侧缘之间的一段
B. 其体表投影基本上与肺尖差不多
C. 延续为上肢各动脉分支的主干
D. 至第一肋外侧缘移行为腋动脉
E. 甲状腺下动脉为其分支之一

正确答案：B。其体表投影基本上与肺尖差不多

解析：锁骨下动脉是指从发出至第一肋外侧缘之间的一段（A对）。其体表投影与肺尖交叉（B错，为本题正确答案）。延续为上肢各动脉分支的主干（C对）。至第一肋外侧缘移行为腋动脉（D对）。甲状腺下动脉为其分支之一（E对）。